外感热病宜选用下列何穴治疗
A. 大椎
B. 二间
C. 内庭
D. 鱼际
E. 后溪

正确答案：A。大椎

解析：大椎主治外感热病，为退热要穴，且督脉主一身之阳气，刺络出血可清泻热邪（A对）。二间主治鼻衄、齿痛等五官疾患；热病（B错）。内庭主治齿痛、咽喉肿痛等五官热性病证；吐酸、腹泻等肠胃病证；足背肿痛，跖趾关节痛（C错）。鱼际主治咳嗽咯血等肺系热性病症；咽喉肿痛，失音（D错）。后溪主治头项强痛、腰背痛等痛症 （E错）。